王不留行性平，除能活血通经外，又能
A. 下乳消肿，利尿通淋
B. 破血痛经，消食化积
C. 化瘀止血，解蛇虫毒
D. 痛经下乳，消肿排脓
E. 化瘀止血，生肌敛疮

正确答案：A。下乳消肿，利尿通淋

解析：本题考查的是王不留行的功效。王不留行性平，除能活血通经外，又能下乳消肿，利尿通淋（A对）。王不留行：【功效】活血通经，下乳消肿，利尿通淋。刘寄奴：【功效】破血通经，散寒止痛，消食化积（B错）。五灵脂：【功效】活血止痛，化瘀止血，解蛇虫毒（C错）。穿山甲：【功效】活血消癥，通经下乳，消肿排脓（D错）。血竭：【功效】活血定痛，化瘀止血，生肌敛疮（E错）。